国家对麻醉药品和精神药品实行
A. 备案管理制度
B. 定点生产制度
C. 分类管理制度
D. 定点经营制度
E. 生产总量控制

正确答案：B、C、D、E。定点生产制度；分类管理制度；定点经营制度；生产总量控制

解析：本题考查麻醉药品和精神药品管理。国家对麻醉药品和精神药品实行定点生产制度（B对）、分类管理制度（C对）、定点经营制度（D对）、生产总量控制（E对）。《麻醉药品和精神药品管理条例》第3条规定，麻醉药品和精神药品目录由国务院药品监督管理部门会同国务院公安部门、国务院卫生主管部门制定、调整并公布。为严格麻醉药品和精神药品生产管理，国家对麻醉药品和精神药品实行定点生产制度。国务院药品监督管理部门按照合理布局、总量控制的原则，根据麻醉药品和精神药品的需求总量，确定麻醉药品和精神药品定点生产企业的数量和布局，并根据年度需求总量对定点生产企业的数量和布局进行调整、公布。国家根据麻醉药品和精神药品的医疗、国家储备和企业生产所需原料的需要确定需求总量，对麻醉药品药用原植物的种植、麻醉药品和精神药品的生产实行总量控制。麻醉药品和精神药品的年度生产计划，是由国务院药品监督管理部门根据麻醉药品和精神药品的需求总量制定。麻醉药品药用原植物年度种植计划，是由国务院药品监督管理部门和国务院农业主管部门根据麻醉药品年度生产计划，共同制定。国家对麻醉药品和精神药品实行定点经营制度，未经批准的任何单位和个人不得从事麻醉药品和精神药品经营活动。